下列不属于神的物质基础的是
A. 血
B. 津液
C. 精
D. 气
E. 肉

正确答案：E。肉

解析：精、气、血、津液不仅是构成和维持人体生命活动的基本物质，也是神赖以产生的物质基础（E错，为本题正确答案）。